42岁，男性。平素多食，肥胖，2次尿糖阳性，空腹血糖5.4mmol/L，饭后2小时血糖7.6mmol/L。最可能的诊断是
A. 药物性糖尿
B. 应激性糖尿
C. 肾性糖尿
D. 肿瘤性糖尿
E. 甲亢致糖尿

正确答案：C。肾性糖尿

解析：中年男性患者，平素多食、肥胖，2次尿糖阳性，测得空腹血糖5.4mmol/L（正常值为3.9～6.0mmol/L），饭后2小时血糖7.6mmol/L（正常值为＜7.8mmol/L），提示血糖均正常，最可能的诊断是肾性糖尿（C对）。肾性糖尿指血糖浓度正常时出现葡萄糖尿，主要由近端肾小管重吸收葡萄糖功能障碍，肾糖阈降低引起，最终使得尿中排出过量葡萄糖（注意：由于血糖浓度正常，肾性糖尿不属于糖尿病的范畴）。甲亢致糖尿（P734）（E错）因碳水化合物在肠道吸收过快引起，一般进食后1/2～1小时血糖升高，出现糖尿，而空腹血糖和餐后2h血糖正常，但患者常多食易饥，伴消瘦。药物性糖尿（P726）（A错）、肿瘤性糖尿（P726）（D错）属特殊类型糖尿病，存在空腹血糖和餐后2h血糖增高。应激性糖尿（P734）（B错）能引起空腹血糖和餐后2h血糖增高，常为暂时性和自限性。